维生素D缺乏性手足搐搦症发生惊厥是由于血清中
A. 钾离子浓度降低
B. 钠离子浓度降低
C. 氯离子浓度降低
D. 钙离子浓度降低
E. 磷离子浓度降低

正确答案：D。钙离子浓度降低

解析：维生素D缺乏时，血钙降低（D对），当血钙浓度＜1.0mmol/L（正常值为2.25～2.75mmol/L）时，可引起神经肌肉兴奋性增加，出现手足抽搦、无热惊厥。手足搐搦症发生惊厥是低钙抽搐所致，虽然血磷、血镁浓度（CE错）也参与血钙浓度的调节，但不是主要调节因素。血钾、血钠浓度（AB错）与惊厥的发生无关。